蛋白结合率为0%的是
A. 磷霉素
B. 伊曲康唑
C. 亚胺培南
D. 头孢曲松
E. 阿莫西林

正确答案：A。磷霉素

解析：本题考查抗菌药物的蛋白结合率。蛋白结合率为0%的是磷霉素（A对）。